慢性骨髓炎的表现是
A. 异常活动
B. 肿胀疼痛
C. 功能障碍
D. 皮肤瘀斑
E. 死骨形成

正确答案：E。死骨形成

解析：慢性骨髓炎炎症反复迁延不愈，病变部位骨组织浸泡在脓液中失去血液供应，导致死骨形成（E对）。异常活动（A错）为骨折专有体征。肿胀疼痛（B错）、功能障碍（C错）为慢性骨髓炎的一般表现，均由局部慢性炎症引起。皮肤瘀斑（D错）为皮下出血的表现。